缓解视疲劳可选用的药物是
A. 酞丁安滴眼液
B. 色甘酸钠滴眼液
C. 氧氟沙星滴眼液
D. 羟甲基纤维素钠滴眼液
E. 毛果芸香碱滴眼液

正确答案：D。羟甲基纤维素钠滴眼液

解析：本题考查缓解视疲劳的药物。缓解视疲劳可选用的药物是羟甲基纤维素钠滴眼液（D对）。人工泪液：玻璃酸钠滴眼液、羟甲基纤维素钠滴眼液、聚乙烯醇滴眼液等改善眼部干燥症状。酞丁安滴眼液（A错）可用于治疗流行性结膜炎，也可用于治疗沙眼。色甘酸钠滴眼液（B错）可用于过敏性结膜炎。氧氟沙星滴眼液（C错）用于又细菌（卡他莫拉菌、大肠埃希菌、变形杆菌）感染所致的结膜炎治疗。毛果芸香碱滴眼液（E错）用于青光眼的治疗。